第一次心包穿刺抽液总量不宜超过
A. 50ml
B. 75ml
C. 100ml
D. 150ml
E. 200ml

正确答案：E。200ml

解析：心包穿刺抽液量第一次不宜超过100～200ml（E对ABCD错），重复抽液可逐渐增加到300～500ml，抽液速度要慢，如抽液过快、过多，心脏受压解除，血液大量回流，射入肺动脉的血液短时间增多，肺组织短时间大量血液淤积，可导致急性肺水肿。